血竭的石油醚提取液加新配制的0.5%醋酸铜溶液，振摇后静置分层，石油醚层不得显绿色，是检查
A. 血竭素
B. 去甲血竭素
C. 海松酸
D. 樟脑
E. 松香

正确答案：E。松香